在问诊过程中，做法错误的是
A. 使患者理解无误
B. 不打断患者的思路
C. 对患者的不良情绪立即批评
D. 不强迫患者回答有关隐私问题
E. 认真倾听，适当反馈

正确答案：C。对患者的不良情绪立即批评

解析：举止端庄，态度和蔼是《医务人员医德规范及实施办法》中对医务人员提出的要求，在问诊中也应当予以遵循，体现对患者的尊重。医患信任是正确诊断的重要因素，医务人员如果衣冠不整就会失去患者的信任，而态度和蔼可以使患者产生亲切感，缓解患者紧张心理，有利于患者倾诉病情，从而获得全面可靠的病史资料（C错，为本题正确答案）。此外问诊语言作为观察和描述疾病状况信息的载体和桥梁，使问诊中的医患沟通和获得疾病信息成为可能。具有医学谈话性质的程序性问诊、聆听与回应问诊、差异性问诊、过渡性问诊等语言，蕴含着丰富的伦理价值判断，坚待问诊时语言得当是问诊的基本伦理要求。孙思邈在《千金要方》中明确提出“凡大医治病，务当安神定志”，因此医务人员在问诊时要安神定志，精力集中，不能心不在痔，要紧紧围绕与判断疾病有关的情况进行交谈。另外还要为患者保守秘密，这既是伦理学上的要求，也是法律上对于患者隐私权保护的要求（ABDE对）。